颈椎损伤的患者在搬运时不正确的是
A. 稳定头部并加以牵引
B. 将患者平直整体移动
C. 颈部应放置小枕
D. 头部两侧加以固定
E. 患者采用侧卧位

正确答案：E。患者采用侧卧位

解析：有颈椎损伤的患者时，应多人同时搬运，一人稳定头部并加以牵引，其他人则以协调的力量将患者平直整体移动，抬到担架上，颈部应放置小枕，头部两侧加以固定，防止头的摆动。掌握“口腔颌面部创伤急救”知识点。